女性，26岁。产后第3天出现寒战高热，腰痛，尿痛，下腹痛，检查：肾区叩击痛，耻骨上压痛，尿白细胞30个/高倍视野，尿蛋白（﹢），血白细胞18×10⁹/L，中性0.86。其诊断是
A. 败血症
B. 肾结核
C. 急性肾盂肾炎
D. 急性膀胱炎
E. 急性肾小球炎

正确答案：C。急性肾盂肾炎

解析：患者出现寒战高热、腰痛、尿痛、下腹痛的症状，检查时肾区叩击痛，耻骨上压痛，均符合急性肾盂肾炎的临床表现；且实验室检查尿白细胞30个/高倍视野，超出正常值，尿蛋白（﹢），血白细胞18×10⁹/L（升高）和中性粒细胞0.86（增多），可诊断为急性肾盂肾炎（C对）。败血症的常见临床表现为持续高热、寒战、全身明显中毒症状，危及生命（A错）。肾结核多表现为尿频尿急尿痛等膀胱刺激症状，可有低热等表现（B错）。急性膀胱炎主要表现为尿频尿急尿痛等膀胱刺激征，一般无发热等全身感染症状（D错）。急性肾小球肾炎特点为血尿、蛋白尿、水肿和高血压（E错）。